心理治疗的伦理要求是
A. 勇担风险，团结协作
B. 掌握手术指征，动机纯正
C. 以健康、稳定的情绪影响患者
D. 对症下药，剂量安全
E. 减轻痛苦，加速康复

正确答案：C。以健康、稳定的情绪影响患者

解析：心理诊治的伦理要求包括保密、尊重、专业、真诚。其中真诚要求医务人员要有深厚的同情心，但要避免把自己的情感、判断和利害掺杂进去，以免误导，因此心理治疗的伦理要求是以健康、稳定的情绪影响患者（C对）。勇担风险，团结协作（A错）是临床急救的伦理要求。掌握手术指征，动机纯正（B错）是手术前治疗的伦理要求。对症下药，剂量安全（D错）是药物治疗对医生的道德要求。减轻痛苦，加速康复（E错）是手术后患者治疗的伦理要求。